女性，32岁。主诉刷牙时常出血，检查发现牙龈肿胀、松动，皮肤有出血、瘀斑。患者可能缺乏
A. 维生素B₁
B. 核黄素
C. 维生素A
D. 维生素C
E. 烟酸

正确答案：D。维生素C